血浆蛋白结合率低，易透过血脑屏障的药物是
A. 磺胺嘧啶
B. 磺胺甲噁唑
C. 磺胺多辛
D. 甲氧苄啶
E. 磺胺米隆

正确答案：A。磺胺嘧啶

解析：本题考查磺胺嘧啶。血浆蛋白结合率低，易透过血脑屏障的药物是磺胺嘧啶（A对）。磺胺嘧啶（SD）口服易吸收，但吸收较缓慢，血药浓度达峰时间为3～6小时，t1/2为8～13小时，是磺胺类中血浆蛋白结合率最低（38%～48%）和血脑屏障透过率最高的药物，在脑脊液中的浓度最高可达血药浓度的80%，因此对防治流行性脑脊髓膜炎有突出疗效，常为首选药。磺胺甲噁唑（B错）为磺胺类抗菌药，属中效磺胺，其血浆蛋白结合率较高（60%～80%），适用于治疗尿道感染。磺胺多辛（C错）血浆蛋白结合率高，约为90%～95%。甲氧苄啶（D错）可穿过血-脑脊液屏障，脑膜无炎症时脑脊液药物浓度为血药浓度的30%～50%,炎症时可达50%～l00%。蛋白结合率为30%～46%。磺胺米隆（E错）外用磺胺类药，不能透过血脑屏障，适用于烧伤和大面积创伤后感染。